脊髓半横断时在截面以下所出现的症状,何者除外
A. 同侧肌肉瘫痪(四肢肌为主)
B. 同侧深部感觉丧失
C. 对侧痛觉丧失
D. 对侧冷觉、热觉丧失
E. 对侧肌肉瘫痪

正确答案：E。对侧肌肉瘫痪

解析：在脊髓中有内侧丘系通过，脊髓半横断时出现损伤平面以下，同侧肢体痉挛性瘫痪，位置觉、震动觉和精细触觉丧失，损伤节段下1-2个节段平面以下的对侧痛、温觉丧失（E错，为本题正确选项）。